腭裂发生于
A. 胚胎第3周
B. 胚胎第6周
C. 胚胎第7周
D. 胚胎第8周
E. 胚胎第9～12周

正确答案：E。胚胎第9～12周

解析：本题考查腭裂的发生时间。腭的发育从胚胎第8周，继发腭突的形成开始，通过与原发腭突的联合与融合，至胚胎第12周，腭基本形成。在此期间（胚胎第9～12周）（E对），若受到某种因素的影响而使各腭突的正常发育及融合受到干扰时，就可能导致腭裂的发生。